舌下神经核所在的部位是
A. 中脑
B. 脑干
C. 脑桥
D. 间脑
E. 延髓

正确答案：E。延髓

解析：舌下神经核所在的部位是延髓（E对）。